氨基苷糖类抗生素不良反应
A. 肾毒性
B. 耳毒性
C. 过敏反应
D. 神经肌肉麻痹
E. 以上均正确

正确答案：E。以上均正确

解析：不良反应：①耳毒性②肾毒性③神经肌肉麻痹④过敏反应掌握“氨基糖苷类抗生素”知识点。